体内dTMP合成的直接前体是
A. dUMP
B. TMP
C. UDP
D. UMP
E. dCMP

正确答案：A。dUMP